结核菌为专性需氧菌常用的培养基是
A. 罗氏培养基
B. 沙保培养基
C. 疱肉培养基
D. 巧克力色培养基
E. 亚碲酸钾培养基

正确答案：A。罗氏培养基

解析：结核菌为专性需氧菌，营养要求高，生长缓慢，常用罗氏培养基（内含蛋黄、甘油、马铃薯和孔雀绿等）进行培养，需3～4周后才形成颗粒状或菜花形的乳酪色的粗糙型菌落。掌握“结核、非结核分枝杆菌”知识点。